辅酶A中所含的维生素是
A. 维生素B₁
B. 维生素B₂
C. 维生素C
D. 泛酸
E. 维生素PP

正确答案：D。泛酸

解析：CoA（辅酶A）和ACP（酰基载体蛋白）中所含的维生素是泛酸（D对）；TPP（焦磷酸硫胺素）中所含的维生素是维生素B₁（A错）；维生素B₂（B错）存在于FAD和FMN中；维生素C（C错）本身是一种辅酶；NAD⁺（烟酰胺腺嘌呤二核苷酸）与NADH⁺（烟酰胺腺嘌呤二核苷酸磷酸）中所含的维生素是维生素PP（E错）。